女，30岁。7个月前孕48天行人工流产术，术后未来月经，雌孕激素试验均阴性，闭经的原因应是
A. 卵巢性闭经
B. 垂体性闭经
C. 下丘脑性闭经
D. 子宫性闭经
E. 难以确定

正确答案：D。子宫性闭经

解析：患者为年轻女性，7个月前孕48天行人工流产术，术后未来月经，孕激素试验（孕激素试验时，若停药后无撤药性出血（阴性反应），应进一步行雌孕激素序贯试验）、雌孕激素试验均阴性（雌孕激素序贯试验时，无撤药性出血者为阴性，应重复一次试验，若仍无出血，提示子宫内膜有缺陷或被破坏，可诊断为子宫性闭经），闭经的原因应是子宫性闭经（D对E错）。诊断垂体性闭经（P355）（B错）时行垂体兴奋试验，若注射LHRH（黄体生成素释放激素）后LH（黄体生成素）不升高或不明显，说明垂体功能减退；若注射LHRH后LH升高，则说明垂体功能正常，是下丘脑闭经（P355）（C错）。卵巢性闭经（P354）（A错）主要特征为促性腺激素升高，属高促性腺素性闭经。